小儿哮喘发作期的主要病机是
A. 外邪引动伏痰，痰阻气道
B. 感受外邪，肺气郁闭
C. 感受外邪，肺气失宣
D. 肺脾肾不足，痰饮内伏
E. 脾肾阳虚，肾不纳气

正确答案：A。外邪引动伏痰，痰阻气道

解析：哮喘发病主要是因为痰饮久伏，遇到诱因，一触即发，痰随气生，气因痰阻，相互搏结，阻塞气道（A对）。外感风邪，由口鼻或皮毛而入，侵犯肺卫，致肺气郁闭；肺失宣降，闭郁不宣，化热灼津炼液成痰，阻于气道，肃降无权，从而出现咳嗽、气喘、痰鸣、鼻煽等肺气闭塞的证候，易发为肺炎喘嗽（B错）。外邪客于肺卫，导致卫阳受遏，肺失宣降，因而出现发热、恶风、咳嗽、鼻塞等症状，因此小儿感冒的病机关键未肺气失宣（C错）。肺脾肾不足，痰饮内伏和脾肾阳虚，肾不纳气都是哮喘发病的病因，不是主要病机（DE错）。